药物先经结缔组织扩散，再经毛细血管和淋巴进入血液循环，一般吸收程度与静注相当的是
A. 静脉注射给药
B. 肺部给药
C. 阴道黏膜给药
D. 口腔黏膜给药
E. 肌内注射给药

正确答案：E。肌内注射给药